分娩时为避免会阴撕裂，应注意保护
A. 耻骨联合与阴道前庭之间
B. 阴道前庭
C. 肛门与尾骨尖之间
D. 肛门与外生殖器之间
E. 尿生殖膈

正确答案：D。肛门与外生殖器之间

解析：分娩时为避免会阴撕裂，应注意保护肛门与外生殖器之间（D对）。